患者，男，34岁，有吸毒史。因过量使用阿片类药物昏迷入急诊抢救，表现为针尖样瞳孔、呼吸抑制，可选用的解救药物是
A. 亚甲蓝
B. 纳洛酮
C. 二巯丙醇
D. 维生素K₁
E. 乙酰半胱氨酸

正确答案：B。纳洛酮

解析：本题考查纳洛酮。纳洛酮（B对）和烯丙吗啡为阿片类药物中毒的首选拮抗剂。亚甲蓝（A错）用于对化学物亚硝酸盐、硝酸盐、苯胺等和含有或产生芳香胺的药物引起的高铁血红蛋白血症有效；对先天性还原型二磷酸吡啶核苷高铁血红蛋白还原酶缺乏引起的高铁血红蛋白血症效果较差；对异常血红蛋白M伴有高铁血红蛋白血症无效，对急性氰化物中毒、能暂时延迟其毒性。二巯丙醇（C错）用于砷、汞、金、铋及酒石酸锑钾中毒。维生素K₁（D错）用于维生素K缺乏引起的出血，如梗阻性黄疸、胆瘘、慢性腹泻等所致出血，香豆素类、水杨酸钠等所致的低凝血酶原血症，新生儿出血以及长期应用广谱抗生素所致的体内维生素K缺乏，也可用于香豆素类杀鼠药中毒。乙酰半胱氨酸（E错）用于对乙酰氨基酚过量所致中毒的解救。